吗啡的镇痛作用机制主要是
A. 抑制外周前列腺素的合成
B. 不影响P物质的释放
C. 阻断痛觉神经冲动的传导
D. 直接作用于痛觉感受器，降低其对致痛物质的敏感性
E. 抑制中枢神经系统，引起痛觉消失

正确答案：C。阻断痛觉神经冲动的传导

解析：本题考查吗啡。吗啡的镇痛作用机制主要是阻断痛觉神经冲动的传导（C对）。阿片类镇痛药通过作用于中枢神经组织内的立体结构特异的、可饱和的阿片受体，选择性地抑制某些兴奋性神经的冲动传递，发挥竞争性抑制作用，从而解除对疼痛的感受和伴随的心理行为反应。